仔细检查见产妇流出的血液有凝血块。此时首选处置应是
A. 输液输血，补充血容量
B. 迅速补给纤维蛋白原
C. 静脉滴注缩宫素
D. 静脉推注麦角新碱
E. 消毒纱条填塞宫腔

正确答案：C。静脉滴注缩宫素

解析：青年初产妇，胎儿及胎盘娩出后，出现时多时少的阴道持续流血已1小时（宫缩乏力性出血，表现为胎盘娩出后，阴道间歇性的出血），考虑子宫收缩乏力引起的产后出血。产后出血先针对出血原因，迅速止血，再输液输血，补充血容量（A错）。该产妇流出的血液中有凝血块，排除凝血功能障碍引起产后出血的可能，不需迅速补给纤维蛋白原（B错）。静脉滴注缩宫素（C对）可加强宫缩迅速止血。静脉滴注麦角新碱（D错）用于治疗产后子宫出血、产后子宫复旧不全（加速子宫复原）、月经过多等，但不如缩宫素常用。消毒纱条填塞宫腔（E错）也可用于宫缩乏力造成的产后出血，但一般不推荐使用。